高钾血症常见的临床表现是
A. 心动过缓
B. 肠蠕动消失
C. 四肢肌张力增强
D. 恶心、呕吐
E. 腹胀

正确答案：A。心动过缓

解析：血钾过高时，导致钠通道失活量多，受到刺激后产生的动作电位幅度、去极化速度及传导速度均降低，对心肌细胞有抑制作用，可引起心动过缓（A对）或心率不齐，严重者可有皮肤苍白。四肢肌张力增强（C错）（八版诊断学P220）可表现为痉挛状态或铅管样强直，为锥体系或锥体外系受损表现。肠蠕动消失（B错）、恶心呕吐（D错）、腹胀（E错）均属于低钾血症引起的肠麻痹表现。